治疗流行性腮腺炎温毒在表应首选
A. 柴胡葛根汤加减
B. 银翘散
C. 普济消毒饮
D. 甘露消毒丹
E. 五味消毒饮

正确答案：A。柴胡葛根汤加减

解析：治疗流行性腮腺炎温毒在表应首选柴胡葛根汤加减，温毒在表为痄腮初起，临床以低热或无发热，耳下腮部肿痛，全身症状不著为特征。治法为和解少阳，散结清肿。选方柴胡葛根汤加减（A对）。银翘散用于风热感冒，发热头痛，口干咳嗽，咽喉疼痛，小便短赤（B错）。普济消毒饮治疗腮腺炎热毒蕴结证（C错）。甘露消毒丹主治湿温时疫，邪在气分，湿热并重证（D错）。五味消毒饮主治疔疮初起，发热恶寒，疮形如粟，坚硬根深，状如铁钉，以及痈疡疖肿，红肿热痛，舌红苔黄，脉数（E错）。